脂溶性较高，起效快，属于巴比妥类的镇静催眠药是
A. 阿普唑仑
B. 异戊巴比妥
C. 地西泮
D. 佐匹克隆
E. 苯巴比妥

正确答案：B。异戊巴比妥

解析：本题考查巴比妥类药物。异戊巴比妥（B对）脂溶性较高，起效快，属于巴比妥类的镇静催眠药；阿普唑仑（A错）为苯二氮䓬类催眠镇静药和抗焦虑药；地西泮（C错）为长效苯二氮䓬类镇静催眠药；佐匹克隆（D错）为环吡咯酮类镇静催眠药；苯巴比妥（E错）脂溶性低，起效慢。